关于食管的位置及狭窄的描述，正确的是
A. 全长约40厘米
B. 行于脊柱与气管之间
C. 第2狭窄位于右主支气管跨越食管前方处
D. 与胸导管共同穿经膈的食管裂孔入腹腔
E. 颈段最长

正确答案：B。行于脊柱与气管之间

解析：食管全长约25cm(A错)，位于脊柱与气管之间(B对)，第2狭窄位于左主支气管跨越食管处(C错)，与下腔静脉共同穿膈的食管裂孔进入腹腔(D错)，胸段最长(E错)。